针对火器伤的初期外科处理原则错误的说法是
A. 钢珠弹造成损伤容易漏诊
B. 严禁初期缝合
C. 已上止血带的患者不必优先处理
D. 积极抗休克
E. 优先处理呼吸、循环不稳定的患者

正确答案：C。已上止血带的患者不必优先处理

解析：初期外科处理原则：①全面了解伤情，分清轻重缓急。优先处理呼吸、循环不稳定、出血不止和已上止血带的伤员；②应争取在伤后6～8小时内实施清创术；③充分显露伤道；④严禁初期缝合；⑤防止感染；⑥小而浅的伤口只需清洗、消毒，然后包扎即可；⑦钢珠弹因伤口小，出血少，容易漏诊。掌握“火器伤、热烧伤”知识点。